确诊前列腺癌的检查是
A. 前列腺穿刺活检
B. 直肠指检
C. 前列腺MRI
D. 前列腺B超
E. 血清PSA检查

正确答案：A。前列腺穿刺活检

解析：直肠指检、血清前列腺特异性抗原（PSA）测定和超声引导下前列腺穿刺活检是诊断前列腺癌的三个主要方法，其中前列腺穿刺活检（A对）是确诊的金标准。直肠指诊（B错）可以发现质地坚硬的前列腺癌结节，一般用于前列腺癌的筛查。前列腺MRI（C错）和前列腺B超（D错）可以发现前列腺内的异常肿块、显示其侵及范围，但无法对肿物进行定性，故不能确诊前列腺癌。血清PSA检查（E错）虽也可用于前列腺癌的诊断，但前列腺炎、良性前列腺增生等疾病也可引起血清PSA水平升高，故诊断价值不及穿刺活检。